细菌个体的繁殖方式是
A. 有性繁殖
B. 菌丝断裂
C. 细胞出芽
D. 无性二分裂
E. 核酸复制

正确答案：D。无性二分裂